药毒重复用药时间
A. 6小时
B. 12小时
C. 18小时
D. 24小时
E. 48小时

正确答案：D。24小时

解析：药毒有一定的潜伏期，第一次发病多在用药后5~20天内，重复用药常在24小时内发生，短者甚至在用药后瞬间或数分钟内发生（D对）。